胰岛素治疗糖尿病最常见的不良反应是
A. 低血糖反应
B. 肝功能损害
C. 过敏反应
D. 皮疹
E. 肾功能损害

正确答案：A。低血糖反应

解析：胰岛素是控制高血糖的重要和有效手段，但由于胰岛素可从已形成的复合物中分离而使游离胰岛素骤增，引起严重低血糖（A对），故应严密监护、及早发现和处理。